生存环境破坏对健康的影响不包括
A. 供水与排水系统破坏
B. 食物短缺与食品卫生问题
C. 医疗卫生资源缺乏
D. 疾病发病率升高
E. 生活环境恶化与疾病流行隐患

正确答案：D。疾病发病率升高